组成蒿芩清胆汤的药物中有
A. 枳实、半夏
B. 黄连、大枣
C. 白术、当归
D. 香附、柴胡
E. 枳壳、陈皮

正确答案：E。枳壳、陈皮

解析：俞氏篙芩清胆汤，陈皮半夏竹茹襄，赤苓枳壳兼碧玉，湿热轻宣此法良（E对）。蒿芩清胆汤的功用为清胆利湿，和胃化痰，主治少阳湿热痰浊证。